下列各项属心阴虚与心血虚共同表现的是
A. 心悸失眠
B. 心烦健忘
C. 乏力自汗
D. 潮热盗汗
E. 脉象细数

正确答案：A。心悸失眠

解析：心悸、失眠可共同见于心阴虚与心血虚梦。心阴虚，虚热扰心，神不守舍，故见失眠；心血虚，心神失养，神不守舍，则为失眠（A对）。心阴虚，虚热扰心，神不守舍，故见心烦健忘（B错）。阴不制阳，虚热内生则潮热盗汗（D错），脉象细数（E错）。心血虚，血为气之母，继而气虚，气虚固摄无力则乏力自汗（C错）。